处方是指由（）在诊疗活动中为患者开具的、由取得药学专业技术职务任职资格的药学专业技术人员审核、调配、核对，并作为患者用药凭证的医疗文书
A. 执业医师
B. 执业助理医师
C. 注册的执业医师
D. 执业医师和执业助理医师
E. 注册的执业医师和执业助理医师

正确答案：E。注册的执业医师和执业助理医师

解析：处方是指由注册的执业医师和执业助理医师在诊疗活动中为患者开具的、由取得药学专业技术职务任职资格的药学专业技术人员审核、调配、核对，并作为患者用药凭证的医疗文书。处方包括医疗机构病区用药医嘱单。掌握“处方管理概述及一般规定、处方权”知识点。